关于酚妥拉明的药理作用，错误的是
A. 舒张血管
B. 拟组胺样作用
C. 拟胆碱作用
D. 增加胃肠平滑肌张力
E. 抑制心脏

正确答案：E。抑制心脏

解析：酚妥拉明的药理作用：①舒张血管、兴奋心脏（A对）（E错，为本题正确答案）②其他：拟胆碱作用（C对），使胃肠平滑肌张力增加（D对）；有拟组胺作用（B对），使胃酸分泌增加；本品还可引起皮肤潮红等。